风俗习惯主要通过什么影响人们的健康
A. 生活环境
B. 劳动条件
C. 行为生活方式
D. 精神生活
E. 心理

正确答案：C。行为生活方式